以下哪项不是龋病的病因
A. 细菌
B. 牙菌斑
C. 遗传
D. 牙齿所处的环境
E. 食物

正确答案：C。遗传

解析：龋病的主要致龋因素包括细菌、牙菌斑、食物以及牙齿所处的环境等。掌握“龋病概述”知识点。